行局部麻醉、穿刺等操作未严格遵守无菌技术造成的继发性感染
A. 牙源性
B. 血源性
C. 损伤性
D. 腺源性
E. 医源性

正确答案：E。医源性

解析：本题考查面颈部淋巴结炎。医务人员行局部麻醉、手术、穿刺等操作未严格遵守无菌技术造成的继发性感染称医源性（E对）感染。